属于雌激素作用的是
A. 宫颈粘液减少
B. 阴道上皮细胞脱落加快
C. 促进乳腺腺泡发育成熟
D. 促进水钠潴留
E. 抑制输卵管肌收缩的振幅

正确答案：D。促进水钠潴留

解析：雌激素的生理作用：1. 促进子宫肌细胞增生和肥大，使肌层增厚；增进血运，促进和维持子宫发育；增加子宫平滑肌对缩宫素的敏感性。2. 使子宫内膜腺体和间质增生、修复。3. 使宫颈口松弛扩张，宫颈黏液分泌增加（A错），性状变稀薄，富有弹性，易拉丝。4. 促进输卵管发育及上皮的分泌活动，并可加强输卵管肌节律性收缩的振幅（E错）。5. 使阴道上皮细胞增生和角化（B错），黏膜变厚，并增加细胞内糖原含量，使阴道维持酸性环境。6. 促进外生殖器和第二性征的发育：促使乳腺管（C错）增生，乳头乳晕着色。7. 协同促卵泡刺激素促进卵泡发育。8. 通过对下丘脑和垂体的正负反馈调节，控制促性腺激素的分泌。9. 促进骨中钙的沉积，加快骨的成熟和骨骺愈合；促进水钠潴留（D对）；促进肝脏高密度脂蛋白的合成，抑制低密度脂蛋白的合成，降低循环中胆固醇水平。